人类乳头瘤病毒的基因组是
A. 双股环状DNA
B. 单股正链DNA
C. 双股环状RNA
D. 单股负链分节段RNA
E. 单股负链不分节段RNA

正确答案：A。双股环状DNA

解析：人乳头瘤病毒（HPV）属于乳多空病毒科乳头瘤病毒属，无包膜，其核衣壳呈20面体立体对称，直径为45～55nm，病毒核酸为双股DNA（dsDNA）。掌握“狂犬病、人乳头瘤病毒”知识点。